设计另外一种与研究问卷在测量内容、应答形式及统计方法等方面高度类似的问卷，同时测量同一研究对象，评价两个问卷测量结果的相关性的是
A. 复测信度
B. 复本信度
C. 准则效度
D. 内容效度
E. 折半信度

正确答案：B。复本信度